女孩，8岁。发热伴头痛及肌肉痛4天。查体：咽充血，扁桃体Ⅰ度肿大，同学中有数人发病，最可能的诊断是
A. 急性上呼吸道感染
B. 急性扁桃体炎
C. 疱疹性咽峡炎
D. 流行性感冒
E. 川崎病

正确答案：D。流行性感冒

解析：该患儿的同学中有数人发病（明显的流行性病史），同时伴有发热、头痛、肌肉痛、咽充血以及扁桃体Ⅰ度肿大的临床表现，符合流行性感冒的特征，应诊断为流行性感冒（D对）。急性扁桃体炎（B错）属于急性上呼吸道感染的一种，急性上呼吸道感染（A错）会有鼻塞、流涕、喷嚏等的典型症状，与该患儿的症状不符。疱疹性咽峡炎的体格检查有咽部充血、在咽腭弓、软聘、腭垂的黏膜上可见多个2～4mm大小灰白色的疱疹（C错）。川崎病一般有长期发热、球结合膜充血、手足硬性水肿和掌跖红斑、颈淋巴结肿大的表现（E错）。